能诱发“流感综合征”的药物是
A. 利福平
B. 多黏菌素
C. 链霉素
D. 哌拉西林
E. 头孢孟多

正确答案：A。利福平

解析：利福平大剂量间歇疗法后偶可出现流“感样症候群”即“流感综合征”（A对），表现为畏寒、寒战、发热、不适、呼吸困难、头昏、嗜睡及肌肉疼痛等，发生频率与剂量大小及间歇时间有明显关系。多黏菌素（B错）、链霉素（C错）、哌拉西林（D错）、头孢孟多（E错）均不会发生“流感综合征”。